使用环磷酰胺对小鼠染毒，经处死动物、收集骨髓细胞、低渗、固定、Giemsa染色等步骤，光镜下可观察到的染色体畸变类型为
A. 着丝点环
B. 相互易位
C. 倒位
D. 插入
E. 重复

正确答案：A。着丝点环